单室模型药物恒速静脉滴注给药，达稳态血药浓度75%，所需要的滴注给药时间
A. 1个半衰期
B. 2个半衰期
C. 3个半衰期
D. 4个半衰期
E. 5个半衰期

正确答案：B。2个半衰期

解析：本题考查单室模型静脉滴注给药。单室模型药物恒速静脉滴注给药，达稳态血药浓度75%，所需要的滴注给药时间为2个半衰期（B对）；假设n表示静脉滴注给药达到坪浓度某一分数所需半衰期的个数，则n=-3.32lg（1-fss）；根据公式n=-3.32lg（1-fss）得当n等于2时达坪分数fss等于75%。